其性走窜，久服易伤正气
A. 穿山龙
B. 威灵仙
C. 五加皮
D. 鹿衔草
E. 乌梢蛇

正确答案：B。威灵仙

解析：本题考查的是威灵仙的使用注意。其性走窜，久服易伤正气威灵仙（B对）。威灵仙：【使用注意】本品性走窜，久服易伤正气，故体弱者慎服。穿山龙（A错）：【使用注意】本品活血通经，故妇女月经期及妊娠期慎服。五加皮（C错）：【主治病证】（1）风湿痹痛，四肢拘挛。（2）肝肾不足所致的腰膝软弱、小儿行迟。（3）水肿，脚气浮肿。鹿衔草（D错）：【使用注意】因其煎剂有避孕作用，故备孕妇女忌用，孕妇慎用。乌梢蛇（E错）：【主治病证】（1）风湿痹痛，筋脉拘挛。（2）中风半身不遂，口眼㖞斜，肢体麻木。（3）破伤风，急慢惊风。（4）麻风，顽癣，皮肤瘙痒。